成人膀胱容积约为
A. 100～0mL
B. 500～800mL
C. 350～500Ml
D. 800～1200mL
E. 150～250mL

正确答案：C。350～500Ml

解析：通常正常成年人的膀胱容量平均350 -500ml（C对）, 最大容量为 800ml;超500ml时，因膀胱壁张力过大而产生疼痛.